宫内节育器并发症不包括
A. 感染
B. 出血
C. 子宫穿孔
D. 腰酸
E. 闭经

正确答案：E。闭经

解析：宫内节育器并发症包括：1.操作不当使节育器异位导致子宫穿孔（C对）、出血（B对）；2.宫内节育器若被细菌污染则会引起感染（A对），4.少数患者会出现腰酸（D对）、白带增多等症状；4.由于宫内节育器放在子宫腔内，不会干扰正常月经，不会引起闭经（E错，为本题正确答案），反而会有带器妊娠的可能。